牙本质磷蛋白说法正确的是
A. 约占所有非胶原有机成分50%
B. 与胶原纤维关系密切
C. 利于牙本质的矿化
D. 在牙本质矿化前沿分布
E. 以上说法均正确

正确答案：E。以上说法均正确

解析：最主要的是牙本质磷蛋白，约占所有非胶原有机成分的50%，在牙本质矿化前沿分布，与胶原纤维关系密切，可结合钙，有利于牙本质的矿化。掌握“牙本质”知识点。